活髓牙修复体粘固后患牙长时间持续疼痛，最可能
A. 已发展为牙髓炎
B. 存在牙龈炎或牙周炎
C. 已发展为根尖周炎
D. 牙本质过敏
E. 已有继发龋，但未发展为牙髓炎

正确答案：A。已发展为牙髓炎

解析：本题考查修复后可能出现的问题。当患牙为活髓牙进行修复，修复体在粘固时，由于消毒药物的刺激、戴冠过程中的机械刺激、冷刺激及粘固剂中游离酸刺激，可能会引起被修复的牙的暂时疼痛，一般粘固后或数小时后疼痛可自行消失。若粘固后牙齿长时间持续疼痛，说明牙髓受激惹严重，造成牙髓炎的发生（A对）。存在牙龈炎或牙周炎（B错）的典型症状是牙龈出血、牙齿松动，而不会出现患牙长时间持续疼痛。发展为根尖周炎（C错）时牙齿多为叩疼明显。牙本质过敏时（D错）牙齿多为遇冷热刺激疼，无持续性疼痛。产生继发龋（E错）是在修复一段时间后才会出现疼痛。